下列中药材中，不属于《非首次进口药材品种目录》收载品种的是
A. 西洋参
B. 枸杞子
C. 西红花
D. 高丽红参

正确答案：B。枸杞子

解析：本题考查《非首次进口药材品种目录》收载品种。下列中药材中，不属于《非首次进口药材品种目录》收载品种的是枸杞子（B错，为本题正确答案）。已列入《非首次进口药材品种目录》的中药材进口品种主要有：西洋参（A对）、乳香、没药及血竭、西红花（C对）、高丽红参（D对）、甘草、石斛、豆蔻、沉香、砂仁、胖大海等。